初戴全口义齿时，发现总义齿左右翘动，加力时患者有痛感。可能引起翘动的原因中不包括进入倒凹区基托未缓冲。在下述造成义齿翘动的原因中，首先考虑的原因应是与硬区相应的基托组织面未做缓冲。当检查出首选原因后，正确的处理方法是
A. 缓冲过长基托
B. 重新制作义齿
C. 垫底
D. 缓冲压痛处硬区的基托组织面
E. 调磨

正确答案：D。缓冲压痛处硬区的基托组织面

解析：本题考查义齿翘动的处理方法。首要原因是与硬区相应的基托组织面未做缓冲，正确的处理是缓冲压痛处的基托组织面（D对）。缓冲多长基托（A错）是为了处理基托过长问题的。重新制作义齿（B错）是一般的处理不能产生理想效果的最后选择。垫底（C错）是固位不好，义齿松动的处理方法。调磨（E错）是为了调磨过高牙尖，消除早接触点。